下列不是氯苯那敏临床应用的是
A. 可用于过敏性鼻炎
B. 用于晕动病引起的呕吐
C. 用于肠胃病引起的呕吐
D. 可用于昆虫咬伤所致的皮肤瘙痒和水肿
E. 对气道炎症有一定的疗效

正确答案：C。用于肠胃病引起的呕吐

解析：氯苯那敏临床应用：①皮肤黏膜变态反应性疾病：H1受体阻断药对荨麻疹、过敏性鼻炎等疗效较好，可作为首选药物，现多用第二代H1受体阻断药。对昆虫咬伤所致的皮肤瘙痒和水肿亦有良效。对血清病、药疹和接触性皮炎也有一定疗效。对支气管哮喘疗效差，对过敏性休克无效。②防晕止吐：用于晕动病、放射病等引起的呕吐，常用苯海拉明和异丙嗪。③其他：某些具有明显镇静作用的H1受体阻断药如异丙嗪可与其他药物如平喘药氨茶碱配伍使用，以对抗氨茶碱中枢兴奋、失眠的副作用，同时也对气道炎症有一定的治疗效果。掌握“H1、H2受体阻断剂”知识点。